肠干
A. 腹腔淋巴结的输出淋巴管形成
B. 纵膈淋巴结的输出淋巴管形成
C. 肠系膜上淋巴结的输出淋巴管形成
D. 肠系膜下淋巴结的输出淋巴管形成
E. 注入乳糜池

正确答案：E。注入乳糜池

解析：腹腔淋巴结（A错）、肠系膜上淋巴结（C错）和肠系膜下淋巴结的输出淋巴管（D错）汇合成肠干。左、右腰干和肠干注入乳糜池（E对）。